下列哪些药物是药酶诱导剂
A. 水合氯醛
B. 苯巴比妥
C. 氯霉素
D. 苯妥英钠
E. 利福平

正确答案：A、B、D、E。水合氯醛；苯巴比妥；苯妥英钠；利福平

解析：本题考查酶诱导作用。水合氯醛（A对）、苯巴比妥（B对）、苯妥英钠（D对）、利福平（E对）是肝药酶诱导剂；氯霉素（C错）是肝药酶抑制剂。